牛奶中的蛋白质主要为
A. 乳蛋白
B. 乳球蛋白
C. 乳蛋白与乳球蛋白
D. 酪蛋白
E. 以上都不对

正确答案：D。酪蛋白